男，40岁。反复上腹疼痛5年余，平卧时加重，弯腰可减轻。查体：上腹部轻压痛，腹部X线示左上腹部钙化。可能的诊断是
A. 慢性胃炎
B. 慢性胆囊炎
C. 慢性胰腺炎
D. 慢性十二指肠球炎
E. 慢性肝炎

正确答案：C。慢性胰腺炎

解析：中年男性患者，反复上腹疼痛5年余，平卧时加重，弯腰可减轻（慢性胰腺炎表现），查体：上腹部轻压痛，X线腹部摄片左上腹部钙化（慢性胰腺炎的典型征象），故患者诊断为慢性胰腺炎（C对）。慢性胃炎一般有胃炎病史，以胃镜及组织学检查为确诊的关键（A错）。慢性胆囊炎一般有胆石症病史，反复胆绞痛表现（B错）。慢性十二指肠球炎一般有恶心、呕吐等症状（D错）。慢性肝炎（B错）多见于30～50岁男性，常见症状是乏力、食欲下降、肝区隐痛，无体重减轻。